下列的人体试验类型中，不需要付出道德代价的是
A. 自体试验
B. 自愿试验
C. 欺骗试验
D. 强迫试验
E. 天然试验

正确答案：E。天然试验

解析：天然试验是不对试验对象进行任何干涉，不受研究者控制的在天然条件下（如战争、早旱灾、水灾、地震、瘟疫及疾病高发区等）的人体试验。这种实验的开始、发展、结束都是自然演进的结果，与研究者的意志无关。这种研究更多的是一种观察性、回顾性的分析和总结，不存在人为控制，因此不存在严格的道德问题（E对）。自体试验是指研究人员利用自己的身体进行的试验研究，以获得相关数据信息（A错）。自愿试验是受试者在一定社会和经济目的的支配下自愿参加的试验（B错）。欺骗手段使受试者参加的人体试验不论其后果如何都是不道德的（C错）。强迫试验是非人道的试验，通常是在武力或政治的压力下，违背受试者本人意愿而进行的试验（D错）。